能量的推荐摄入量等于人群能量的
A. 平均需要量
B. 平均需要量＋10%
C. 平均需要量＋20%
D. 平均需要量＋标准差
E. 平均需要量＋2个标准差

正确答案：A。平均需要量

解析：本题考查能量的推荐摄入量。能量的推荐摄入量（RNI）等于人群能量的平均需要量（EAR）（A对BCDE错）。